24岁。初产妇，妊娠38周，规律宫缩7小时，血压110/70mmHg，骨盆不小，预测胎儿体重为2800g，枕左前位，胎心良，肛诊宫口开大4cm，S=0。本例正确处置应是
A. 不需干涉产程进展
B. 人工破膜
C. 静脉滴注25%硫酸镁16ml
D. 静脉滴注缩宫素
E. 静脉推注地西泮10mg

正确答案：A。不需干涉产程进展

解析：青年初产妇，妊娠38周（妊娠28周及以后为妊娠晚期），血压110/70mmHg（正常值：收缩压90～139mmHg，舒张压60～89mmHg），骨盆不小，胎儿体重2800g（正常胎儿体重为2500～4000g），胎心良，规律宫缩7小时，宫口开大4cm，S=0（说明胎头已衔接），该孕妇处于正常产程，因此不需干涉产程进程（A对）。人工破膜（P189）（B错）适用于协调性宫缩乏力，宫口扩张≥3cm、无头盆不称、胎头已衔接而产程延缓者。静脉滴注25%硫酸镁（P71）（C错）是预防和控制子痫的方法。静脉滴注缩宫素（P189）（D错）适用于协调性宫缩乏力或使不协调宫缩乏力恢复协调性。静脉推注地西泮（P189）（E错）适用于宫口扩张缓慢及宫颈水肿者。